在胃酸中不稳定，易被破坏的抗生素是
A. 红霉素
B. 琥乙红霉素
C. 克拉霉素
D. 阿奇霉素
E. 罗红霉素

正确答案：A。红霉素

解析：本题考查抗生素。红霉素（A对）在胃酸中不稳定，易被破坏。琥乙红霉素（B错）在胃酸中稳定且无味。克拉霉素（C错）在胃酸中稳定、味苦。阿奇霉素（D错）对胃酸稳定，在组织中浓度较高，半衰期较长。罗红霉素（E错）在胃酸中稳定，口服吸收迅速，在肺组织中浓度较高。